男，78岁。腰骶部疼痛2个月。直肠指诊前列腺增大，有结节，质地坚硬且侵犯直肠，血清PSA80.6ng/ml，前列腺穿刺活检诊断前列腺癌，放射性核素骨显像见腰椎转移病灶。应选择的最佳治疗方法是
A. 根治性前列腺切除术+内分泌治疗
B. 根治性前列腺切除术
C. 观察，对症处理
D. 双侧睾丸切除术
E. 药物去势+抗雄激素制剂

正确答案：E。药物去势+抗雄激素制剂

解析：前列腺癌临床分期多采用TNM分期系统，分为4期。T1期分为T1a期：偶发肿瘤体积＜所切除组织体积的5%，直肠指检正常；T1b期：偶发肿瘤体积＞所切除组织体积的5%，直肠指检正常；T1c期：单纯PSA升高，穿刺活检发现肿瘤，直肠指检及经直肠超声正常。T2期分为T2a期：肿瘤局限于并＜单叶的1/2；T2b期：肿瘤局限于并＞单叶的1/2；T2c期：肿瘤侵犯两叶，但仍局限于前列腺内。T3期分为T3a期：肿瘤侵犯并突破前列腺一叶或两叶包膜；T3b期：肿瘤侵犯精囊。T4期：肿瘤侵犯膀胱颈、尿道外括约肌、直肠、肛提肌和（或）盆壁。该患者前列腺癌已侵犯直肠，且有腰椎转移，故已属T4期。T4期前列腺癌患者多已失去手术根治机会，治疗以内分泌治疗为主，由于前列腺癌的发病与双氢睾酮有关，因此需行去势治疗，配合抗雄激素制剂可以提高患者的生存率。去势治疗可采用药物去势或手术去势（即双侧睾丸切除术）。因此，该患者最佳的治疗方法是药物去势+抗雄激素制剂（E对）。根治性前列腺切除术（AB错）适用于局限在前列腺包膜以内（T1b、T2期）的前列腺癌。前列腺癌为恶性肿瘤，须及时行药物或手术治疗，以延长患者生存期、提高患者的生存质量，不能只观察、对症处理（C错）。单纯的双侧睾丸切除术（D错）的治疗效果不及药物去势+抗雄激素制剂。